患者男，下颌双侧5678缺失，双侧下颌4余留牙正常，口底距舌侧龈缘的距离为4mm。如果设计铸造支架可摘局部义齿，设计RPI卡环组。取本例患者下颌模型时应采用何种印模方法
A. 解剖式印模
B. 静态印模
C. 无压力印模
D. 功能性印模
E. 一次印模

正确答案：D。功能性印模

解析：双侧游离端缺失印模要求取功能性印模。掌握“暂时冠及印模与模型”知识点。